肺孢子菌肺炎治疗首选
A. 氯霉素
B. 卡泊芬净
C. 克林霉素
D. 氨苯芬
E. 复方新诺明

正确答案：E。复方新诺明

解析：氯霉素（A错）可用于有特效作用的伤寒、副伤寒和立克次体病等及敏感菌所致的严重感染。卡泊芬净（B错）主要用于经验性治疗中性粒细胞减少、伴发热病人的可疑真菌感染，治疗对其它治疗无效或不能耐受的侵袭性曲霉菌病。克林霉素（C错）适用于革兰氏阳性菌引起的下列各种感染性疾病。氨苯砜（D错）与其他抗麻风药联合用于由麻风分枝杆菌引起的各种类型麻风的治疗，也可用其他皮肤病的治疗。复方新诺明（E对）为磺胺类抗菌药，对于卡氏肺孢子虫肺炎的治疗为首选。